患者，女，30岁胁部皮肤灼热疼痛2天后患部皮肤出现簇集粟粒大小丘状疱疹，呈带状排列，疱壁紧张，口苦，心烦，脉弦数治疗本病除局部阿是穴夹脊外，宜选取
A. 阴陵泉内庭
B. 血海三阴交
C. 神门大陵
D. 外关风池
E. 行间侠溪

正确答案：E。行间侠溪

解析：患者胁部皮肤灼热疼痛2天后患部皮肤出现簇集粟粒大小丘状疱疹，呈带状排列辨病为蛇串疮，伴有“壁紧张，口苦，心烦，脉弦数辨证为肝经火毒证”。治疗蛇串疮的主穴有行间，为足厥阴肝经荥穴，具有疏肝泻热之功；配穴侠溪治疗肝经火毒（E对）。阴陵泉治疗脾经湿热；内庭可以清降胃火、通涤腑气（A错）。血海治疗瘾疹、湿疹、丹毒等血热性皮肤病；三阴交为三阴经交会穴，可健脾利湿（B错）。神门为心之原穴，可宁心安神；大陵治疗心胃神志病，臂手挛痛（C错）。外关为足少阳经与阳维脉的交会穴，治疗热病、五官病、瘰疬、胁肋痛、上肢痿痹不遂；风池治疗内外风所致病证及颈项强痛（D错）。